津液输布的主要通道是
A. 血府
B. 经络
C. 腠理
D. 三焦
E. 分肉

正确答案：D。三焦

解析：三焦为水液和诸气运行的通路，三焦的通利保证了诸多脏腑输布津液的道路通畅，于是津液才能升降出入，在体内正常地流注布散。若三焦水道不利，也会导致水液停聚，发为多种病症（D对）。血府为血液运行的管道（A错）。经络是运行全身气血，联络脏腑形体官窍，沟通上下内外，感应传导信息的通路系统（B错）。